现有60例心脏移植患者，随访观察其术后5年存活情况，其中2例由于迁居国外而失访，36例在随访结束时存活，而20例在随访期中由于心脏原因发生死亡，2例由于意外事故发生死亡。以下属于完全数据的为
A. 由于迁居国外而失访的2例
B. 随访结束时仍存活的36例
C. 由于心脏原因死亡的20例
D. 由于意外事故发生死亡的2例
E. 以上均不是

正确答案：C。由于心脏原因死亡的20例

解析：本题考完完全数据的概念。完全数据是指从观察起点到发生终点事件所经历的时间。本题研究的是心脏移植患者随访观察术后5年的存活情况，由于心脏原因死亡的数据为完全数据，为20例（C对ABDE错）。